某女，78岁。素体虚弱，患高血压病20年。刻下头晕目眩、心悸失眠、耳鸣如蝉、目昏、喘促。证属肝阳上亢、心神不宁、肾不纳气，宜选用的药是
A. 磁石
B. 赭石
C. 朱砂
D. 龙骨
E. 珍珠母

正确答案：A。磁石

解析：本题考查磁石的主治病证。证属肝阳上亢、心神不宁、肾不纳气，宜选用的药是磁石（A对）。磁石【主治病证】（1）心神不宁，心悸失眠，惊风癫痫。（2）肝阳上亢，头晕目眩。（3）耳鸣，耳聋，目昏。（4）肾虚喘促。赭石（B错）【主治病证】（1）肝阳上亢之头晕目眩。（2）嗳气，呃逆，呕吐，喘息。（3）血热气逆之吐血、衄血、崩漏。朱砂（C错）【主治病证】（1）心火亢盛之心神不安、胸中烦热、惊悸不眠，癫狂，癫痫。（2）疮疡，咽痛，口疮。龙骨（D错）【主治病证】（1）心神不安，心悸失眠，惊痫，癫狂。（2）肝阳上亢之烦躁易怒、头晕目眩。（3）自汗，盗汗，遗精，带下，崩漏。（4）湿疮湿疹，疮疡溃后不敛。珍珠母（E错）【主治病证】（1）肝阳上亢之头晕目眩，惊悸失眠。（2）肝热目赤，肝虚目昏。（3）湿疹，湿疮。